对21-三体综合征最具诊断价值的是
A. 智能发育落后
B. 特殊愚型面容
C. 体格发育落后
D. 染色体核型分析
E. 通贯手

正确答案：D。染色体核型分析

解析：智勇发育落后（A错）、特殊愚型面容（B错）、体格发育落后（C错）、通贯手（E错）是对21-三体综合征的临床表现，没有特异性，并且具有主观性存在。21-三体综合征是染色体病变性遗传病，因此确诊该病应进行染色体核型分析以确诊（D对）。